参苓白术散含有的功效是
A. 疏肝
B. 通便
C. 举陷
D. 补血
E. 渗湿

正确答案：E。渗湿

解析：参苓白术散方中以人参补益脾胃之气，白术、茯苓健脾渗湿，共为君药。山药补脾益肺，莲子肉健脾涩肠，扁豆健脾化湿，薏苡仁健脾渗湿，均可资健脾止泻之力，共为臣药。佐以缩砂仁芳香醒脾，行气和胃，化湿止泻。桔梗宣利肺气，炙甘草、大枣补脾和中，调和诸药，而为佐使。诸药相合，益气健脾，渗湿止泻（E对）。逍遥散有疏肝（A错）的功效。麻子仁丸有通便（B错）的功效。补中益气汤有举陷（C错）的功效。四物汤有补血（D错）的功效。